一个眼球的视网膜节细胞发出的轴突
A. 直接投射到两侧视觉中枢
B. 投射到两侧的外侧膝状体
C. 全部投射到同侧的外侧膝状体
D. 全部投射到对侧的外侧膝状体
E. 投射到两侧的内侧膝状体

正确答案：B。投射到两侧的外侧膝状体

解析：一个眼球的视网膜节细胞发出的轴突汇集成视神经，经视交叉后形成视束，最后投射到外侧膝状体。因此，左侧视束内含有来自两眼视网膜左侧半的纤维，右侧视束内含有来自两眼视网膜右侧半的纤维，最后投射到两侧的外侧膝状体（B对）。